下列哪项不是月经后期血虚证的临床表现
A. 经期延后，量少
B. 经色淡红无血块
C. 小腹胀痛
D. 心悸、少寐
E. 舌淡红、脉细

正确答案：C。小腹胀痛

解析：月经后期血虚证主要是由于营血亏虚，冲任不充，血海不能如期满溢，营血不足，血海虽满而所溢不多，故月经周期延后，量少（A对）；血虚赤色不足，精微不充故经色淡红无血块（B对）；血虚不能养心神，故心悸、少寐（D对）；血不充舌脉，则舌淡红、脉细（E对）。月经后期血虚导致胞脉失养，当小腹绵绵作痛，而非胀痛（C错，为本题正确答案）。